在某工地食堂用餐后半小时左右，有多名工人口唇指甲和全身皮肤出现紫绀，并出现精神萎靡、头晕、头痛、乏力、心跳加速，有的伴有恶心、呕吐、腹胀、烦燥不安、呼吸困难。其最大可能是
A. 河豚鱼中毒
B. 四季豆中毒
C. 亚硝酸盐中毒
D. 沙门菌中毒
E. 葡萄球菌肠毒素中毒

正确答案：C。亚硝酸盐中毒

解析：患病工人最大可能是亚硝酸盐中毒（C对）。中毒工人出现紫绀，并出现精神萎靡、头晕、头痛、乏力、心跳加速，有的伴有恶心、呕吐、腹胀、烦燥不安、呼吸困难。这些都是亚硝酸盐中毒（C对）的典型临床表现。河豚鱼中毒（P328）（A错）主要临床表现是口唇麻痹、恶心呕吐、腹痛腹泻、严重的有眼睑下垂、全身麻痹甚至死亡。最重要的是有河豚食用史。四季豆中毒（P330）（B错）多表现为急性胃肠炎症状、没有发绀表现。沙门菌中毒（P326）（D错）潜伏期一般4～48小时，腹泻一日可数次至十数次，为有恶臭的黄色或黄绿色水样便，有时还伴有脓血。同时伴有高热。没有发绀。葡萄球菌肠毒素中毒（P326）（E错）潜伏期一般2～4小时主要表现为低热、恶心呕吐、腹痛腹泻，腹泻多为水样便或黏液便，无发绀。